下列属于乌梅丸的功用是
A. 温脏安蛔
B. 消食化滞
C. 健脾消痞
D. 消食止泻
E. 软坚散结

正确答案：A。温脏安蛔

解析：乌梅丸方中重用味酸之乌梅以安蛔，使蛔静痛止，为君药。以味辛性温之蜀椒、细辛，温脏而驱蛔；味苦性寒之黄连、黄柏，清热而下蛔，共为臣药。附子、干姜、桂枝助其温脏祛寒、伏蛔之力；人参、当归益气补血，扶助正气，与桂、附姜相配，既可养血通脉，以除四肢厥冷，亦有利于温脏安蛔，合为佐药。炼蜜为丸，甘缓和中，为使药。诸药合用，共奏温脏安蛔、扶正祛邪之功（A对）。